女，45岁。间断水肿3年，乏力3个月，查体：BP155/100mmHg，双下肢轻度凹陷性水肿，尿RBC20-30/HP，尿蛋白2.1g/L，血Hb78g/L，血Cr342umol/L，BUN16lmmol/L，B超示双肾稍萎缩。最可能的临床诊断是
A. 慢性肾小球肾炎
B. 慢性间质性肾炎
C. 急性肾小球肾炎
D. 高血压肾损害
E. 肾病综合征

正确答案：A。慢性肾小球肾炎

解析：中年女性患者，病程3年，临床表现为间断水肿、乏力，查体：BP155/100mmHg（高血压2级），双下肢轻度凹陷性水肿，尿RBC20～30/HP（正常值0～3个/HP），尿蛋白2.lg/d（正常值≤150mg/d），血Hb78g/L（正常值成年女性：110～150g/L，提示中度贫血），血Cr342umol/L（正常值（女）70～108μmol/L，提示肾功能受损），BUN16lmmol/L（正常值2.86～7.14mmol/L，提示肾功能受损），B超示双肾稍萎缩。根据临床表现、体查、实验室检查及影像学检查，最可能的临床诊断是慢性肾小球肾炎（A对）。慢性间质性肾炎（B错）常表现为肾小管功能损害，如夜尿多、低比重及低渗尿（P490）。急性肾小球肾炎（C错）也表现为肾炎综合征，可有一过性肾功能不全（P466），患者间断水肿3年，不可能为急性肾小球肾炎。高血压肾损害（D错）患者是先有长期高血压病史，患者常先有较长的高血压病史，再出现肾小管浓缩功能受损，表现为夜尿增多，不会出现血尿。肾病综合征（E错）诊断的必备条件是尿蛋白＞3.5g/d、血浆蛋白＜30g/L，且不会出现血尿（P470）。